糖尿病一般不会出现的血管病变是
A. 玻璃样变性
B. 淀粉样变性
C. 纤维素样坏死
D. 纤维素样变性
E. 钙化

正确答案：B。淀粉样变性

解析：糖尿病的血管病变包括玻璃样变性（A对）、纤维素样变性（D对）、纤维素样坏死（C对）、脂肪变性、粥样硬化、钙化（E对）。淀粉样变性（B错，为本题正确答案）是胰岛病变。